被称为“血海”的经脉是
A. 冲脉
B. 带脉
C. 任脉
D. 督脉
E. 阴维脉

正确答案：A。冲脉

解析：本题考查的是冲脉的基本功能。被称为“血海”的经脉是冲脉（A对）。冲脉的基本功能（1）调节十二经气血，故称“十二经脉之海”。（2）冲为血海，有促进生殖之功能，并同妇女的月经有着密切的联系。带脉（B错）的基本功能（1）约束纵行诸经。（2）主司妇女的带下。任脉（C错）的基本功能（1）调节阴经气血，故称“阴脉之海”。（2）主持妊养胞胎。督脉（D错）的基本功能（1）调节阳经气血，故称“阳脉之海”。（2）与脑、髓和肾的功能有关。